患者，男，23岁。恶寒，发热，鼻塞声重，流清涕，头痛，咳嗽，口不渴，舌苔薄白，脉浮紧。其治法是
A. 清暑解表
B. 益气解表
C. 滋阴解表
D. 辛温解表
E. 辛凉解表

正确答案：D。辛温解表

解析：题中患者以恶寒，发热，鼻塞声重，流清涕，头痛，咳嗽为主症，故诊断为感冒。恶寒，发热为风寒之邪外束肌表，卫阳被郁所致。风寒上受，肺气失宣，故鼻塞声重，流清涕，咳嗽；清阳不展，络脉失和，故头痛；寒为阴邪，故口不渴；舌苔薄白，脉浮紧为表寒之象，故辨为风寒束表证。清暑解表为感冒暑湿伤表证的治法（A错）。益气解表为气虚感冒的治法（B错）。滋阴解表为阴虚感冒的治法（C错）。题中辨证为感冒风寒束表证，治宜辛温解表（D对）。辛凉解表为感冒风热犯表证的治法（E错）。